胸膜下界体表投影，错误的是
A. 左侧起点为第6肋软骨
B. 右侧起点为第6肋软骨
C. 锁骨中线与第8肋相交
D. 腋中线与第10肋相交
E. 肩胛线与第11肋相交

正确答案：B。右侧起点为第6肋软骨

解析：胸膜下界左侧起点为第6肋软骨（A对），右侧起点为第6胸肋关节（B错，为本题正确答案）。胸膜下界在锁骨中线与第8肋相交（C对），在腋中线与第10肋相交（D对），在肩胛线与第11肋相交（E对）。